臀先露孕妇于妊娠26周来院就诊，应采取的处理措施是
A. 内转胎位术
B. 暂不需处理
C. 左侧卧位
D. 外转胎位术
E. 胸膝卧位

正确答案：B。暂不需处理

解析：该孕妇妊娠26周（＜30周），臀先露多能自行转为头先露，故暂不需处理（B对）。若妊娠30周后仍为臀先露应予矫正，常用的矫正方法有：胸膝卧位（E错）而不是左侧卧位（C错）、激光照射或艾灸至阴穴、外转胎位术（D错）。内转胎位术（A错）常用于横位而无剖宫条件时，易导致子宫破裂，伤害母体和胎儿。